男性，50岁，下颌765│6缺失，8│前倾，与对颌牙接触不良，余牙正常。设计牙支持式义齿时，8│上卡环应设计
A. 三臂卡环
B. 对半卡环
C. 圈形卡环
D. 回力卡环
E. 倒钩卡环

正确答案：C。圈形卡环

解析：对于向近中舌向倾斜的远中孤立的下颌磨牙，适合采用圈形卡环，卡臂尖进入舌侧近中的倒凹。此时如果采用三臂卡环，卡臂尖位于远中，不能进入倒凹，无固位作用。对半卡环、回力卡环和倒钩卡环也都不适用于该基牙。圈形卡环：又称环形卡环，多用于最后的磨牙上，基牙向近中舌侧或近中颊侧倾斜。掌握“局部义齿固位体”知识点。